西咪替丁的禁忌症是
A. 急性胰腺炎
B. 胃食管反流病
C. 卓-艾综合征
D. 应激性溃疡
E. 上消化道出血

正确答案：A。急性胰腺炎

解析：本题考查西咪替丁的禁忌症。西咪替丁的禁忌症是急性胰腺炎（A对）。西咪替丁的适应证：用于胃及十二指肠溃疡、吻合口溃疡、应激性溃疡（D错）、胃食管反流病（B错）、卓-艾综合征（C错）、上消化道出血（E错）。